痛经气血虚弱证的治法
A. 理气化瘀止痛
B. 温经暖宫止痛
C. 益气养血止痛
D. 清热除湿，化瘀止痛
E. 益肾养肝止痛

正确答案：C。益气养血止痛

解析：痛经气血虚弱证的病机是气血不足，冲任亦虚，经行之后，血海更虚，子宫、冲任失于濡养，不荣则痛；治宜补气养血，调经止痛；方用温中补气，和里缓急之黄芪建中汤（C对）。温经暖宫止痛（B错）为痛经寒湿凝滞证的治法；痛经气滞血瘀证治宜理气化瘀止痛（A错）；痛经湿热瘀滞证治宜清热除湿，化瘀止痛（D错）；益肾养肝止痛（E错）为痛经肝肾亏损证的治法。